患者男性，52岁，晨起后发现右口角下垂，右眼不能完全闭合，检查时还发现右侧舌前2/3味觉迟钝，同侧舌、颊及口底黏膜与对侧相比均显干燥、无光泽。右侧听力也较对侧差，Schirmer试验正常，该患者面神经损害部位可能在
A. 脑桥与膝状神经节之间
B. 膝状神经节
C. 镫骨肌与膝状神经节之间
D. 鼓索及镫骨肌之间
E. 茎乳孔以外

正确答案：C。镫骨肌与膝状神经节之间

解析：本题考查面神经麻痹。根据味觉、听觉及泪液检查结果，还可明确面神经损害部位，从而作出相应的损害定位诊断，镫骨肌与膝状神经节之间（C对）：面瘫+味觉丧失+唾液腺分泌障碍+听觉改变。